（104～105题共用题干）女，26岁。人流后5个月，阴道不规则出血20天，伴头晕、乏力3天。近2天，出现胸痛、咯血。妇科检查：子宫孕7周大小，质软，有轻度压痛，双侧可触及囊性肿物，直径均为5cm大小。胸部X线片提示双下肺多发圆形结节影。为明确诊断，首选的检查是
A. B超
B. 血常规
C. 诊断性刮宫
D. 痰细胞学检查
E. 血β-hCG

正确答案：E。血β-hCG

解析：患者女，26岁。人流后5个月，阴道不规则出血20天，伴头晕、乏力3天（阴道流血，人流后继发妊娠滋养细胞肿瘤典型表现，无葡萄胎病史）。近2天，出现胸痛、咯血（绒癌肺转移）。妇科检查：子宫孕7周大小（子宫增大），质软，有轻度压痛，双侧可触及囊性肿物，直径均为5cm大小。胸部X线片提示双下肺多发圆形结节影（X线征象发展为片状或小结节阴影（P340）是妊娠滋养细胞肿瘤常见表现）。明确诊断，首选的检查是血β-hCG（E对）。B超（A错）是诊断子宫原发病灶最常用方法，对于妊娠滋养细胞肿瘤可支持诊断但不是必须。血常规（B错）对明确诊断无帮助。诊断性刮宫（C错）用于判断子宫内膜情况或用于止血，常用于诊断宫血。痰细胞学检查（D错）多应用于肺部相关疾病的诊断。